既活血，又行气的药物有
A. 水蛭
B. 郁金
C. 莪术
D. 益母革
E. 延胡索

正确答案：B、C、E。郁金；莪术；延胡索